抗抑郁的药是
A. 格列齐特
B. 苯海索
C. 丙咪嗪
D. 氯苯那敏
E. 甲基多巴

正确答案：C。丙咪嗪

解析：本题考查抗抑郁药。丙咪嗪（C对）为三环类抗抑郁药。格列齐特（A错）为磺酰脲类促胰岛素分泌药。苯海索（B错）为治疗帕金森的药物。氯苯那敏（D错）为组胺H₁受体阻断药。甲基多巴（E错）通过作用于中枢神经系统，激活血管运动神经中枢α₂受体，减少交感神经冲动传出，降低血压。